某女，48岁。大便溏泻，水谷不化，稍进油腻之物，则大便次数增多，饮食减少，恶心呕吐，脘腹疼痛，胀闷不舒，伴面色萎黄，肢倦乏力；舌淡苔白，脉细弱。宜选用的中成药是
A. 连蒲双清片
B. 四神丸
C. 加味保和丸
D. 人参健脾丸
E. 槟榔四消丸

正确答案：D。人参健脾丸

解析：本题考查的是泄泻的辨证论治。大便溏泻，水谷不化，稍进油腻之物，则大便次数增多，饮食减少，恶心呕吐，脘腹疼痛，胀闷不舒，伴面色萎黄，肢倦乏力；舌淡苔白，脉细弱。宜选用的中成药是人参健脾丸（D对）。泄泻是以排便次数增多，粪质稀溏或完谷不化，甚至泻出如水样为主症的疾病。西医学的急性肠炎、肠易激综合征、炎症性肠病等有上述表现者，可参考此内容辨证论治。（一）寒湿内盛证：【症状】泄泻清稀，甚则如水样，脘闷食少，腹痛肠鸣，或兼见外感风寒，恶寒，发热，头痛，肢体酸痛。舌苔白或白腻，脉濡缓。【中成药应用】常用中成药有藿香正气水、五苓散。（二）湿热伤中证：【症状】泄泻腹痛，泻下急迫，势如水注，或泻而不爽，粪色黄褐，气味臭秽，肛门灼热，烦热口渴，小便短黄。舌质红，苔黄腻，脉滑数或濡数。【中成药应用】常用中成药有肠康片、香连片、痢必灵片（糖衣片）、泻痢消胶囊、连蒲双清片（A错）、白蒲黄片。（三）食滞肠胃证：【症状】腹痛肠鸣，泻下粪便臭如败卵，泻后痛减，泻下伴有不消化食物，脘腹胀满，嗳腐吞酸，不思饮食。舌淡红，苔垢浊或厚腻，脉滑实。【中成药应用】常用中成药有加味保和丸（C错）、枳实导滞丸、和中理脾丸。（四）肝气乘脾证：【症状】腹痛而泻，腹中雷鸣，攻窜作痛，矢气频作，每因抑郁恼怒或情绪紧张之时而泻，素有胸胁胀闷，嗳气食少。舌质淡，脉弦。【中成药应用】常用中成药有痛泻宁颗粒、养胃颗粒。（五）脾胃虚弱证：【症状】大便时溏时泻，迁延反复，食少，食后脘闷不舒，稍进油腻食物，则大便次数增多，面色萎黄，神疲倦怠。舌质淡，苔白，脉细弱。【中成药应用】常用中成药有人参健脾丸（大蜜丸）、补中益气丸（水丸）、参苓健脾胃颗粒。（六）肾阳虚衰证：【症状】黎明前脐腹作痛，肠鸣即泻，泻后则安，完谷不化，腹部喜暖，形寒肢冷，腰膝酸软。舌淡苔白，脉沉细。【中成药应用】常用中成药有四神丸（B错）、桂附理中丸、固本益肠片、肠胃宁片。槟榔四消丸（E错）为胃痛饮食伤胃证的中成药应用。胃痛饮食伤胃证：【症状】胃脘疼痛，胀满拒按，嗳腐恶食，或吐不消化食物，吐后或矢气后痛减，大便不爽。舌淡红，苔厚腻，脉滑。【中成药应用】常用中成药有槟榔四消丸（大蜜丸）、开胸顺气丸、沉香化滞丸、加味保和丸。